疫源地的消灭必须满足
A. 传染源被移走或消除了排菌状态
B. 传染源散播在外界环境中的病原体被彻底清除
C. 所有易感的接触者经该病最长潜伏期观察，未出现新病例或感染
D. A＋B＋C
E. 以上都不是

正确答案：D。A＋B＋C

解析：本题考查疫源地消灭的条件。疫源地的消灭必须具备下列条件：①传染源被移走或不再排出病原体；②通过各种措施消灭了传染源排到外环境的病原体；③传染源周围的所有易感接触者经过该病最长潜伏期没有出现新病例或新感染者。ABC选项均描述准确（D对ABCE错）。